最容易诱导免疫耐受的细胞是
A. B细胞
B. Mφ
C. 单核细胞
D. T细胞
E. NK细胞

正确答案：D。T细胞

解析：高剂量抗原引起的耐受称高带耐受。低剂量抗原引起的耐受称低带耐受。诱导T细胞耐受所需抗原量小，发生快，持续时间久（低带免疫耐受）。诱导B细胞耐受所需抗原量大，发生慢，持续时间短（高带免疫耐受）。故T细胞最容易诱导免疫耐受。掌握“免疫耐受”知识点。